小儿急性肾小球肾炎风水相搏证的首选方剂是
A. 麻黄连翘赤小豆汤
B. 银翘散
C. 五味消毒饮
D. 葱豉桔梗汤
E. 藿香正气散

正确答案：A。麻黄连翘赤小豆汤

解析：急性肾小球肾炎风水相搏证是由于风遏水阻，水湿溢于肌表所致，治以疏风利水，方药为麻黄连翘赤小豆汤（A对）。银翘散（B错）其功用为辛凉透表，清热解毒，可用于风热感冒。五味消毒饮（C错）与小蓟饮子合用，其功用为清热利湿，凉血止血，可用于急性肾小球肾炎之湿热内侵证。葱豉桔梗汤（D错）其功用为辛凉解肌，疏风清热，适用于风温初期。藿香正气散（E错）其功用为解表化湿，理气和中，适用于外感风寒，内伤湿滞证。